单侧髁突颈部骨折，伤侧髁突的移位方向为
A. 向前内
B. 向前外
C. 向前上
D. 向前下
E. 向后下

正确答案：A。向前内

解析：本题考查单侧髁突颈部骨折伤侧髁突的移位方向。髁突骨折多发生在翼外肌附着下方的髁突颈部。折断的髁突由于受翼外肌的牵拉而向前内移位（A对），但仍可留在关节囊内。向前上（C错）、向后下（E对）移位可见于双侧颏孔区骨折时，两侧后骨折段因升颌肌群牵拉而向前上方移位，前骨折段则因降颌肌群的作用而向后下方移位。